属于牙拔除术绝对禁忌症的是
A. 糖尿病
B. 妊娠期
C. 冠心病
D. 急性肝炎
E. 慢性肾病

正确答案：D。急性肝炎

解析：急性肝炎期间不应拔牙。慢性肝炎肝功能有明显损害者，会导致术后出血。肝炎病员需拔牙时应作凝血酶原和出、凝血时间检查，术中还应加用止血药物。对肝炎病员，特别是乙型肝炎病员术中应注意防止医源性交叉感染。掌握“牙拔除的适应证与禁忌证”知识点。